影响药品稳定性的药物因素有
A. 贮存温度
B. 日光照射
C. 化学结构
D. 药物辅料
E. 人员结构

正确答案：C、D。化学结构；药物辅料

解析：本题考查影响药物制剂稳定性的因素。影响药品稳定性的药物因素有化学结构（C对）、药物辅料（D对）。不同药物的化学结构不同，某些药物的化学结构不稳定，容易水解或氧化等，导致药品不稳定，因此化学结构是影响药品稳定性的药物因素。药物辅料对药品的稳定性有一定影响，如一些半固体制剂的稳定性与其基质有关，一些片剂的润滑剂对药物的稳定性有一定影响。药品的贮存温度（A错）、日光照射（B错）是影响药品稳定性的外界因素，而非药物因素。人员结构（E错）与药品的稳定性无关。